在无机硒代谢转化（解毒）过程中，能为其提供甲基的物质是
A. S-腺苷蛋氨酸
B. 蛋氨酸腺昔转移酶
C. 谷胱甘肽过氧化物酶
D. 细胞色素氧化酶
E. 还原型谷胱甘肽

正确答案：A。S-腺苷蛋氨酸

解析：本题考查在无机硒代谢转化（解毒）过程中，能为其提供甲基的物质。在无机硒代谢转化（解毒）过程中，需要消耗大量S-腺苷蛋氨酸（A对BCDE错）为其提供甲基，才能形成毒性相对较低的二甲基硒化合物。